老年帕金森患者的治疗最适当的治疗药物是
A. 安坦
B. 复方左旋多巴
C. 司来吉兰
D. 溴隐亭
E. 维生素E

正确答案：B。复方左旋多巴

解析：帕金森是由于黑质内多巴胺能神经元退行性变导致纹状体内多巴胺减少或缺乏，而左旋多巴（B对）是多巴胺的前体且可透过血脑屏障，能够补充纹状体内多巴胺的不足即针对病因予以治疗所以是最适当的治疗药物。安坦（A错）也称苯海索（P135），属于促进多巴胺释放药，对PD疗效有限，副作用较多，现已少用。司来吉兰（C错）（P133）属于多巴胺的增敏药，降低脑内的DA降解代谢，使多巴胺浓度增加，有效时间延长，但是确切疗效尚不肯定，有待于大范围临床观察。溴隐亭（D错）（P134）属于多巴胺受体激动药，但是不良反应较多，消化系统以及心血管系统都有不良反应，且可以诱发心律失常，故对老年帕金森患者的治疗不是最恰当的药物。维生素E（E错）为体内的一种维生素，对帕金森没有治疗作用。